多呈纺锤形；表面棕褐色或黑褐色，有纵皱纹及6-10个略隆起的环节，节上有未除净的棕色毛须及须根断痕；去净毛须者较光滑，环节不明显，该药材是
A. 泽泻
B. 山麦冬
C. 香附
D. 三棱
E. 天麻

正确答案：C。香附

解析：本题考查的是香附的性状鉴别。多呈纺锤形；表面棕褐色或黑褐色，有纵皱纹及6-10个略隆起的环节，节上有未除净的棕色毛须及须根断痕；去净毛须者较光滑，环节不明显，该药材是香附（C对）。香附【性状鉴别】药材多呈纺锤形，有的略弯曲，长2～3.5cm，直径0.5～1cm。表面棕褐色或黑褐色，有纵皱纹，并有6～10个略隆起的环节，节上有未除净的棕色毛须及须根断痕；去净毛须者较光滑，环节不明显。泽泻（A错）【性状鉴别】药材呈类球形、椭圆形或卵圆形，长2～7cm，直径2～6cm。表面淡黄色至淡黄棕色，有不规则的横向环状浅沟纹和多数细小突起的须根痕，底部有的有瘤状芽痕。山麦冬（B错）【性状鉴别】药材湖北麦冬：呈纺锤形，两端略尖，长1.2～3cm，直径0.4～0.7cm。表面淡黄色至棕黄色，具不规则纵皱纹。质柔软，干后质硬脆，易折断，断面淡黄色至棕黄色，角质样，中柱细小。三棱（D错）【性状鉴别】药材呈圆锥形，略扁，长2～6cm，直径2～4cm。表面黄白色或灰黄色，有刀削痕，须根痕小点状，略呈横向环状排列。体重，质坚实。天麻（E错）【性状鉴别】药材呈椭圆形或长条形，略扁，皱缩而稍弯曲，长3～15cm，宽1.5～6cm，厚0.5～2cm。表面黄白色至淡黄棕色，有纵皱纹及由潜伏芽排列而成的横环纹多轮，有时可见鳞叶或棕褐色菌索。顶端有红棕色至深棕色鹦嘴状的芽苞或残留茎基；底部有圆脐形疤痕。